女，27岁。妊娠19周，阵发性下腹痛2天，阴道少量流血8小时。为决定是否能继续妊娠，应选用的辅助检查方法为
A. 尿妊娠试验
B. B型超声检查
C. 检测血清雌二醇值
D. 检测血清雌三醇值
E. 检测血常规

正确答案：B。B型超声检查

解析：患者妊娠19周（妊娠12周以后的流产为晚期流产），阵发性下腹痛2天，阴道少量流血8小时（晚期流产的临床表现主要为先出现腹痛，后出现阴道流血）。此患者为阵发性腹痛，且流血较少，考虑先兆流产的诊断。为决定是否能继续妊娠，应选用的辅助检查方法为B型超声检查（B对）。B型超声可以观察妊娠囊的状态、胎心搏动情况，确定胚胎或胎儿是否存活，从而决定是否能继续妊娠。尿妊娠试验（A错）能协助了解流产的预后，但并不是决定是否能继续妊娠的主要辅助检查（P49）。血孕酮水平能协助判断先兆流产的预后，而不是检测血清雌二醇值（C错）和检测血清雌三醇值（D错）（P49）。检测血常规（E错）为先兆流产的常规检查，但不能决定是否能继续妊娠。